某女，30岁。感冒3日，症见恶寒、发热、无汗，头重而痛，肢体酸痛。证属外感风寒夹湿。治当疏风解表、散寒除湿，宜选用的成药是
A. 午时茶颗粒
B. 双黄连颗粒
C. 感冒清热颗粒
D. 九味羌活丸
E. 桑菊感冒颗粒

正确答案：D。九味羌活丸

解析：本题考查的是九味羌活丸的功能。感冒3日，症见恶寒、发热、无汗，头重而痛，肢体酸痛。证属外感风寒夹湿。治当疏风解表、散寒除湿，宜选用的成药是九味羌活丸（D对）。九味羌活丸：【功能】疏风解表，散寒除湿。午时茶颗粒（A错）：【功能】祛风解表，化湿和中。双黄连颗粒（B错）：【功能】疏风解表，清热解毒。感冒清热颗粒（C错）：【功能】疏风散寒，解表清热。桑菊感冒颗粒（E错）：【功能】疏风清热，宣肺止咳。